高血压病肾小球细动脉管壁增厚狭窄
A. 细胞水肿
B. 脂质沉积
C. 结缔组织玻璃样变
D. 血管壁玻璃样变
E. 细胞内玻璃样变

正确答案：D。血管壁玻璃样变

解析：高血压病时，肾小球细动脉最主要的病变表现为血管壁玻璃样变（D对），其特点为细动脉管壁增厚狭窄，血压升高，受累脏器局部缺血。细胞水肿（A错）又称水样变（P15），是指因胞质内离子浓度调节功能障碍导致细胞内大量水分蓄积的现象。脂质沉积（B错）于非脂肪细胞可引起脂肪变性，多发生于肝细胞。结缔组织玻璃样变（P17）（C错）和细胞内玻璃样变（P16）（E错）是玻璃样变的另外两种的类型，前者常见于萎缩的子宫和乳腺间质等；后者常见于酒精性肝病等。